某人进食午餐后回家，1小时左右出现头疼、头晕、恶心、呕吐、视物模糊、瞳孔缩小如针尖大、呼吸困难等症状，到卫生所就医，初步诊断是中毒。如检测患者血中胆碱酯酶，其活性减少的范围可能是
A. 10%～20%
B. 20%～30%
C. 30%～40%
D. 40%～50%
E. 70%以上

正确答案：E。70%以上